心衰时引起夜间阵发性呼吸困难的机制包括以下哪种
A. 迷走神经兴奋性降低
B. 呼吸中枢敏感性增高
C. 左心衰竭而右心功能尚好
D. 平卧肺淤血急剧加重
E. 冠状动脉血流减少，心功能下降

正确答案：D。平卧肺淤血急剧加重

解析：心衰引起夜间阵发性呼吸困难的机制包括①平卧位时，下半身静脉血液回流不受重力影响，因而回流增多，使得水肿液吸收入血增多，加重肺淤血（D对）；②入睡后迷走神经兴奋性增高（A错），使小支气管收缩，气道阻力增大；③熟睡后呼吸中枢敏感性降低（B错），只有当肺淤血程度较为严重，动脉血氧分压降低到一定程度时，方能刺激呼吸中枢，使患者感到呼吸困难而惊醒。